女，14岁。初潮后月经周期紊乱，经期长短不一已有5个月。肛门检查：子宫发育正常，双侧附件未见异常。首选的辅助检查是
A. B型超声检查
B. 基础体温测定
C. X线检查
D. 血雌激素水平测定
E. 诊断性刮宫

正确答案：B。基础体温测定

解析：患者为青春期女性（无排卵性功血好发于青春期和绝经过渡期），初潮后月经周期紊乱，经期长短不一已有5个月，子宫发育正常，双侧附件未见异常，考虑为无排卵性功能失调性子宫出血。为明确诊断，首选的辅助检查是基础体温测定（B对），其不仅有助于判断卵巢有无排卵，还可提示黄体功能不足、子宫内膜不规则脱落。B型超声检查（P346）（A错）能了解子宫的大小、形状、子宫内膜的厚度及宫腔有无占位病变；血雌激素水平测定（D错）可了解雌激素水平，提示卵巢功能是否正常，但两者均不能了解卵巢有无排卵及判断黄体功能。X线检查（C错）对无排卵性功血没有诊断意义。诊断性刮宫（P347）（E错）主要用于年龄＞35岁、药物治疗无效或存在子宫内膜癌高危因素的异常子宫出血患者。